下列方法中，能够保存更多的牙体组织的修复术的是
A. 银汞合金充填术
B. 复合树脂直接粘结修复术
C. 嵌体修复术
D. 根管治疗术
E. 窝沟封闭术

正确答案：B。复合树脂直接粘结修复术

解析：本题考查树脂粘结概念及釉质、牙本质粘结。传统的银汞合金修复技术（A错），必须预备洞形为修复材料提供机械固位力，故需切割较多的牙体组织。而复合树脂直接粘结修复术（B对）通过粘接系统使修复材料与牙体组织紧密结合，可以保存更多的牙体组织。嵌体（C错）对牙体组织的切削量也较大，而窝沟封闭术（E错）不是修复技术，而是预防技术中的一种。根管治疗术（D错）对牙体组织的切削量也较大。